患者惊悸不寐，胸闷胁胀，头晕目眩，口干口苦，舌苔黄腻，脉弦滑者。其证型是
A. 心火亢盛
B. 痰火扰心
C. 胆郁痰扰
D. 肝胆湿热
E. 肝火犯肺

正确答案：C。胆郁痰扰

解析：患者多由情志不遂，胆气郁结，气郁生痰化火，痰火内扰，胆气不宁而成。痰火内盛，扰乱于胆，胆气不宁，失于决断，故惊悸失眠，胆怯易惊，烦躁不安，处事犹豫不决；胆气上溢，则口苦呕恶；胆郁气滞，则胸闷胁胀；痰阻清阳，火扰清窍，故眩晕耳鸣；舌红苔黄腻，脉弦滑为痰热之症（C对）。